易于导致咳嗽少痰，或痰粘难咳，或喘息胸痛等症状的邪气是
A. 风邪
B. 寒邪
C. 暑邪
D. 湿邪
E. 燥邪

正确答案：E。燥邪

解析：燥邪侵袭，易伤津液，而与外界接触的皮肤、清窍和肺系首当其冲。燥邪犯肺，肺津耗损，肺失滋润，清肃失职，故干咳少痰，或痰少而黏难以咳出，咳甚损伤血络，而见胸痛等症（E对）。风邪侵袭人体可表现为新起恶风、微热、汗出、脉浮缓，或突起风团、瘙痒、麻木、肢体关节游走疼痛等症（A错）。寒邪侵袭人体以恶寒甚、无汗、头身或胸腹疼痛、苔白、脉浮紧等为主要表现的实寒证（B错）。暑邪侵袭人体耗气伤津，以发热、口渴、疲乏、汗出、尿黄等为主要表现的证候（C错）。湿邪以身体困重、肢体酸痛、腹胀腹泻等为主要表现的证候（D错）。